正态分布曲线的位置与以下哪项有关
A. 均数
B. 标准差
C. 标准误
D. 中位数
E. 方差

正确答案：A。均数

解析：正态分布曲线以均数为中心，随着均数的变动，曲线就会沿着X轴平行移动。掌握“定量资料的统计描述和推断”知识点。